下列哪项不是牙齿脱位后伴发的各种并发症
A. 牙髓坏死
B. 牙髓腔变窄或消失
C. 牙根外吸收
D. 边缘性牙槽突吸收
E. 逆行性牙髓炎

正确答案：E。逆行性牙髓炎

解析：本题考查牙脱位。逆行性牙髓炎（E错，为本题正确答案）不是牙齿脱位后伴发的各种并发症。牙齿脱位后，可以发生各种并发症：牙髓坏死（A对）；牙髓腔变窄或消失（B对）；牙根外吸收（C对）；边缘性牙槽突吸收（D对）。